女性，59岁。因患乳腺癌在硬膜外麻醉下行根治术，出血较多，即输“AB”型红细胞悬液2个单位，当输入20ml左右时出现畏寒胸闷胸背疼痛，呼吸急促，脉搏加速，血压下降，立即停止输血，经处理1小时体温升至39℃，排尿一次，呈浓茶样，量少。最可能的输血不良反应是
A. 非溶血性发热性输血反应
B. 输血相关的急性肺损伤
C. 急发性的溶血性输血反应
D. 细菌感染反应
E. 过敏反应

正确答案：C。急发性的溶血性输血反应

解析：患者输入20ml左右红细胞悬液后出现畏寒、胸闷、胸背疼痛，呼吸急促，脉搏加速，血压下降，后出现发热、浓茶样尿（浓茶样尿提示出现血红蛋白尿）。根据患者症状体征分析，其最可能发生的输血不良反应是即发性的溶血性输血反应（C对）。溶血反应（P22）的典型症状为病人输入十几毫升血型不合的血后，立即出现沿输血静脉的红肿及疼痛，寒战、高热、呼吸困难、腰背酸痛、头痛、胸闷、心率加快乃至血压下降、休克，随之出现血红蛋白尿和溶血性黄疸。需注意：输血后发生腰背酸痛与浓茶样或酱油样尿（即血红蛋白尿）提示出现溶血，此为常考考点。非溶血性发热性输血反应（A错）多因免疫反应或血液中含有致热原引起，虽也会出现畏寒、发热等症状，但无血红蛋白尿、无腰背酸痛。输血相关的急性肺损伤（P23）（B错）常发生在输血后1～6小时内，主要表现为急性呼吸困难、双侧肺水肿和低氧血症，不会出现溶血相关的反应。细菌污染反应（P23）（D错）主要表现为寒战、高热、血压下降等内毒素休克症状，严重时也可出现血红蛋白尿，但发生率不高。过敏反应（E错）主要表现为皮肤局限性或全身性瘙痒或荨麻疹。